不属于韦氏环结构的是
A. 咽扁桃体
B. 颌下淋巴结
C. 腭扁桃体
D. 舌扁桃体
E. 鼻后部其他淋巴组织

正确答案：B。颌下淋巴结